胆总管是由什么汇合而成
A. 肝右管与肝左管
B. 胆囊颈与肝总管
C. 胆囊管与肝总管
D. 肝总管与胰管
E. 肝右管与肝总管

正确答案：C。胆囊管与肝总管

解析：胆总管由胆囊管与肝总管(C对)汇合而成。